属于椎弓间的连接是
A. 前纵韧带
B. 黄韧带
C. 翼状韧带
D. 椎间盘
E. 后纵韧带

正确答案：B。黄韧带

解析：椎弓间连结有：黄韧带（B对）、棘间韧带、棘上韧带和项韧带、横突间韧带、关节突关节。椎体间连结有：椎间盘（D错）、前纵韧带（A错）、后纵韧带（E错）。翼壮韧带（C错）是寰枢关节，连结脊柱与颅骨，不输于椎弓间连结。